主张以行动者的行为所产生的可能或实际效果作为道德价值之基础或评价标准的是伦理学基本理论中的
A. 义务论
B. 效果论
C. 美德论
D. 规范论
E. 阶级论

正确答案：B。效果论

解析：效果论又称目的论，主张以行动者的行为所产生的可能或实际效果作为道德价值之基础的或评价标准。掌握“伦理学”知识点。